女，38岁。进行性贫血、消瘦、乏力半年，有时右腹隐痛，无腹泻。查体：右中腹部扪及肿块，肠音活跃。下列各项检查可明确诊断的是
A. 结肠镜
B. CEA
C. CT
D. B超
E. 全消化道钡餐

正确答案：A。结肠镜

解析：患者消瘦、乏力，贫血，右中腹肿块（右侧结肠癌的典型症状），考虑为结肠癌，为明确此病最好的诊断方式是活组织病理检查，纤维结肠镜可以直观的了解病变情况，并获取活组织以进行病理检查，故结肠镜（A对）可明确诊断。CEA（癌胚抗原）（B错）一般用于结肠癌术后复发和预后的判断，且仅有45%病人升高，不具有明确诊断价值。CT（C错）、B超（D错）可以用来检查癌肿转移以及淋巴结肿大情况，不适合结肠癌的诊断。全消化道钡餐（E错）效果有限，不具有确诊价值。